构成青少年体质物质基础的是
A. 身体形态
B. 生理功能
C. 身体素质
D. 运动能力
E. 心理发育

正确答案：A。身体形态